脊髓后角固有核的功能性质是
A. 躯体运动
B. 躯体感觉
C. 内脏感觉
D. 交感神经
E. 副交感神经

正确答案：B。躯体感觉

解析：Ill层和Ⅳ层内较大的细胞群组成后角固有核，功能性质为躯体感觉（B对）。